女，25岁。脐周及右下腹痛2个月。伴低热，午后为著，无寒战，体温未测，排便次数增多，大便每日2~3次，呈糊状，无黏液、无脓血。查体：T37.5℃，P80次/分，R23次/分，BP120/80mmHg。体型消瘦。双肺呼吸音清，未闻及干湿性啰音，心律齐。右下腹压痛，移动性浊音（-）。X线钡剂造影见升结肠挛缩，回盲部有跳跃征。最可能的诊断是
A. 结肠癌
B. 慢性菌痢
C. 克罗恩病
D. 肠结核
E. 溃疡性结肠炎

正确答案：D。肠结核

解析：患者午后低热，消瘦（结核症状），脐周及右下腹痛，腹泻呈糊状，无黏液、无脓血，X线钡剂造影见升结肠挛缩，回盲部有跳跃征（肠结核特有体征）。最可能的诊断是肠结核（D对）。结肠癌（A错）比肠结核发病年龄大，一般无结核毒血症表现。克罗恩病（C错）表现为纵行溃疡、黏膜呈卵石样。溃疡性结肠炎（E错）表现为黏液脓血便。